与2％普鲁卡因比较，以下哪项不是2％利多卡因的特点
A. 毒性较大，但可用作表面麻醉
B. 有较强的组织穿透性和扩散性
C. 麻效强，起效快
D. 有抗室性心律失常作用
E. 维持时间较短

正确答案：E。维持时间较短

解析：本题考查利多卡因的特点。利多卡因麻醉作用持续时间较长（E错，为本题的正确答案）。利多卡因有较强的组织穿透性和扩散性（B对），虽然利多卡因的毒性是普鲁卡因的2倍，但仍可用作表面麻醉（A对）。因为利多卡因较强的组织穿透性和扩散性，故利多卡因的麻醉起效比普鲁卡因更快，麻效更强（C对）。利多卡因在低剂量时，可促进心肌细胞内K⁺外流，降低心肌的自律性，使心脏传导速度减慢、房室传导阻滞，具有抗室性心率失常作用（D对）。